结构与β受体拮抗剂相似，同时具有β受体拮抗作用以及钠离子通道阻滞作用，主要用于室性心律失常的是
A. 普罗帕酮
B. 美西律
C. 胺碘酮
D. 多非利特
E. 奎尼丁

正确答案：A。普罗帕酮

解析：本题考查普罗帕酮。普罗帕酮（A对）结构与β受体拮抗剂相似，具有β受体拮抗作用及钠离子通道阻滞作用。美西律（B错）是将利多卡因中的酰胺键替换为醚键，不具备β受体拮抗作用。胺碘酮（C错）结构与甲状腺素类似，含有碘原子，可影响甲状腺素代谢。多非利特（D错）结构为甲磺酰胺。奎尼丁（E错）是生物碱类药物，是抗疟药物奎宁的立体异构体，不具备β受体拮抗作用。